甲苯中毒与苯中毒的毒作用，主要不同是
A. 麻醉作用
B. 呼吸道刺激作用
C. 脱脂性皮炎
D. 造血系统损伤
E. 类神经症

正确答案：D。造血系统损伤

解析：本题考查苯与甲苯中毒的区别。高浓度甲苯主要对中枢神经系统产生麻醉作用；对皮肤黏膜的刺激作用较苯为强，皮肤接触可引起皮肤红斑、干燥、脱脂及皲裂等，甚或出现结膜炎和角膜炎症状。甲苯对血液系统（D对ABCE错）无明显影响，但慢性苯中毒最为标志性的影响则是对血液系统的影响。